关于牙隐裂治疗原则最佳的选项是
A. 对因治疗
B. 对症治疗
C. 防止劈裂
D. 以上均正确
E. 以上均不正确

正确答案：D。以上均正确

解析：牙隐裂治疗原则：①对因治疗：调除创伤性咬合力，调磨过陡的牙尖；均衡全口咬合力的负担；诊治其他部位的牙齿疾病，修复缺失牙等。②对症治疗：出现并发症时进行相应治疗。③防止劈裂：a.在做牙髓治疗前，应先对患牙予以降（牙合）处理，并磨除牙冠裂纹后用复合树脂粘接；或用钢丝结扎、带环或临时冠保护，防止牙髓治疗过程中牙冠劈裂。b.牙髓治疗过程应尽量一疗次完成，缩短时间，减少术中劈裂的风险。c.牙髓治疗后，行永久充填修复。掌握“隐裂”知识点。